对主要目标细菌耐药率超过50%的抗菌药物，医疗机构应采取的细菌耐药预警机制和措施是
A. 慎重经验用药
B. 参照药敏试验结果选用
C. 及时将预警信息通报本机构医务人员
D. 暂停对此目标细菌的临床应用

正确答案：B。参照药敏试验结果选用

解析：本题考查的是抗菌类药物的细菌耐药预警。对主要目标细菌耐药率超过50%的抗菌药物，医疗机构应采取的细菌耐药预警机制和措施是参照药敏试验结果选用（B对）。抗菌类药物的细菌耐药预警：医疗机构应当开展细菌耐药监测工作，建立细菌耐药预警机制，并采取下列相应措施：①主要目标细菌耐药率超过30%的抗菌药物，应当及时将预警信息通报本医疗机构医务人员（C错）；②主要目标细菌耐药率超过40%的抗菌药物，应当慎重经验用药（A错）；③主要目标细菌耐药率超过50%的抗菌药物，应当参照药敏试验结果选用；④主要目标细菌耐药率超过75%的抗菌药物，应当暂停针对此目标细菌的临床应用（D错），根据追踪细菌耐药监测结果，再决定是否恢复临床应用。